心悸失眠，夜多异梦，平素胆怯易惊，苔白腻，脉弦滑者，治宜选用
A. 二陈汤
B. 温胆汤
C. 导痰汤
D. 酸枣仁汤
E. 半夏白术天麻汤

正确答案：B。温胆汤

解析：该题考查温胆汤的主治病证。心悸失眠，夜多异梦，平素胆怯易惊，与心胆气虚证相似，但结合苔白腻，脉弦滑可知为胆郁痰扰证，为胆气不足，胆失疏泄，气郁生痰，痰浊内扰，胆胃不和所致。二陈汤功能燥湿化痰，理气和中，主治湿痰证（A错）。温胆汤功能理气化痰，和胃利胆，主治胆郁痰扰证（B对）。导痰汤功能燥湿祛痰，行气开郁，主治痰厥证。（C错）。酸枣仁汤功能养血安神，清热除烦，主治肝血不足，虚热内扰证（D错）。半夏白术天麻汤功能化痰息风，健脾祛湿，主治风痰上扰证（E错）。